适合制备难溶性药物灰黄霉素滴丸的基质是
A. MCC
B. EC
C. HPMCP
D. CAP
E. PEG

正确答案：E。PEG

解析：本题考查难溶性药物基质的选择。灰黄霉素极微溶于水，对热稳定，熔点为218～224℃；PEG6000（E对）的熔点为60℃，以1：9比例混合，使135℃时可以成为两者的固态溶液。因此，在135℃下保温、滴制、骤冷，可形成简单的低共溶混合物，使95%灰黄霉素均为粒径2微米以下的微晶分散。